某男，68岁。半年前因中风，遗留半身不遂，口眼㖞斜，言语謇涩，出院后常规服用阿司匹林肠溶片（每次100mg，每日1次）。近2周，因过度劳累，患侧肢体无力、活动不便加重，伴浮肿，面色少华；伸舌右偏，舌色淡紫，舌边有瘀斑，苔薄白，脉细涩无力。医师诊断为中风，证属气虚血瘀，处方如下：黄芪30g，桃仁10g，当归6g，川芎9g，红花10g，赤芍10g，地龙6g，半夏6g，7剂，水煎服，每日1剂，早、晚分服。关于对该案例开展药学服务的说法，错误的是
A. 建议中药处方选用炒桃仁、酒赤芍、生黄芪
B. 建议黄芪一般用量为30～60g，长期服用，每日用量不宜超过120g
C. 建议桃仁捣碎后入煎，水煎温服，每日2次，宜餐前服用
D. 患者不欲服用汤剂，建议改服消栓胶囊，每次2粒，每日3次，饭后服用
E. 建议患者加强偏瘫肢体的被动活动，进行各种功能锻炼

正确答案：D。患者不欲服用汤剂，建议改服消栓胶囊，每次2粒，每日3次，饭后服用

解析：本题考查的是中风的健康指导。半年前因中风，遗留半身不遂，口眼㖞斜，言语謇涩，出院后常规服用阿司匹林肠溶片（每次100mg，每日1次）。近2周，因过度劳累，患侧肢体无力、活动不便加重，伴浮肿，面色少华；伸舌右偏，舌色淡紫，舌边有瘀斑，苔薄白，脉细涩无力。医师诊断为中风，证属气虚血瘀，处方如下：黄芪30g，桃仁10g，当归6g，川芎9g，红花10g，赤芍10g，地龙6g，半夏6g，7剂，水煎服，每日1剂，早、晚分服。患者不欲服用汤剂，建议改服消栓胶囊，每次2粒，每日3次，饭前半小时服用（D错，为本题正确答案）。中风气虚血瘀证：【症状】肢体偏枯不用，肢软无力，面色萎黄。舌质淡紫或有瘀斑，苔薄白，脉细涩或细弱。【方剂应用】基础方剂为补阳还五汤（黄芪、当归、川芎、桃仁、红花、赤芍、地龙）加减。【中成药应用】常用中成药有脉络通颗粒、软脉灵口服液、脑安颗粒、消栓胶囊、复方地龙胶囊。补阳还五汤的合理用药与用药指导：（1）饮片选择：补阳还五汤出自清代《医林改错》。选用当归尾，破血逐瘀力强。选用生黄芪，补气行滞效佳。选用桃仁泥或炒桃仁，以活血化瘀。选用炒赤芍，寒性已缓，清热凉血之力稍减，适用于血瘀兼脾胃虚寒者；酒赤芍则行血之力强，适用于气虚血瘀之胸痹（A对）。（2）剂量建议：原方中黄芪用量最大，其次是当归尾。黄芪用量要适宜，要突出补气活血的特点，用量宜大但不应太过，应考虑到连续、累积的治疗过程，同时结合患者的气虚程度及脾胃功能权衡用之。一般情况下，黄芪的用量应控制在30～60g之间；气虚程度较甚，同时又无其他禁忌时，可逐渐增加至60g以上，但连续用量不宜超过120g（B对）。（3）煎法服法：水煎温服，每日2～3次，宜餐前服用（C对）。桃仁宜捣碎后入煎。中风的健康指导：1.饮食宜忌：饮食宜食清淡易消化之物，忌肥甘厚味、动风、辛辣刺激之品，并禁烟酒。2.日常调护：关于中风的预防，明代李用粹《证治汇补·预防中风》强调：“平人手指麻木，不时眩晕，乃中风先兆，须预防之。宜慎起居，节饮食，远房帏，调情志。”上述表明，应识别中风先兆，及时处理，以预防中风发生。要保持心情舒畅，做到起居有常，饮食有节，避免疲劳，以防止卒中发病。既病之后，应加强护理。遇中脏腑昏迷时，须密切观察病情变化，注意面色、呼吸、汗出等变化，以防向闭脱转化。加强口腔护理，及时清除痰涎，喂服或鼻饲中药时应少量多次频服。恢复期要加强偏瘫肢体的被动活动，进行各种功能锻炼（E对），并配合针灸、推拿、理疗按摩等。偏瘫严重者，防止患肢受压而发生变形。语言不利者，宜加强语言训练。长期卧床者，保护局部皮肤，防止发生压疮。